百会穴前、后、左、右各开1寸处是
A. 头维穴
B. 四神聪
C. 阳白穴
D. 攒竹穴
E. 太阳穴

正确答案：B。四神聪

解析：四神聪（B对）在百会前后左右各开1寸处，因4穴，故又名四神聪。头维（A错）在头部，额角发迹直上0.5寸，头正中线旁开4.5寸；阳白（C错）在头部，眉上1寸，瞳孔直上；攒竹（D错）在面部，眉头凹陷中，额切迹处；太阳（E错）在头部，当眉梢与目外龇之间，向后的一横指的凹陷中。